感觉身体不适后没有及时去医院就诊，这种行为属于
A. 违规行为
B. 预警行为
C. 致病行为模式
D. 不良疾病行为
E. 不良生活方式与习惯

正确答案：D。不良疾病行为